威灵仙的主治病证不包括
A. 风寒湿痹
B. 痰饮积聚
C. 瘫痪麻木
D. 诸骨鲠喉
E. 吐泻转筋

正确答案：E。吐泻转筋